女，57岁，临床：牙龈边缘及牙龈乳头充血水肿，全口牙龈增生覆盖牙冠的1／3～1／2，下前牙出现松动移位。为确定诊断最应重点询问
A. 家族史
B. 绝经史
C. 高血压史
D. 口腔卫生史
E. 口呼吸习惯

正确答案：C。高血压史

解析：本题考查药物性牙龈肥大。根据病例描述，牙龈边缘及牙龈乳头充血水肿，全口牙龈增生覆盖牙冠的1/3～1/2，下前牙出现松动移位，可知牙龈增生程度较重，且伴有明显的牙龈炎症，则可初步诊断为药物性牙龈肥大。与药物性牙龈增生有关的三类常用药物是：抗癫痫药、免疫抑制剂和钙通道阻滞剂。钙通道阻滞剂常作为高血压患者的降压药，近年来，随着我国高血压患病率的增高，服用该类药物的患者增多，临床上钙拮抗剂诱导的牙龈增生已居药物性牙龈增生的首位，因此为进一步确诊应重点询问患者是否有高血压史（C对），是否长期服用钙通道阻滞剂类药物。家族史（A错）主要存在于牙龈纤维瘤病患者中，牙龈纤维瘤病的牙龈增生程度较重，增生牙龈一般覆盖牙冠的2/3以上，伴发的慢性龈炎较少且程度轻，该病例不考虑为此病，故不需侧重询问家族史。绝经史（B错）的询问常涉及因激素水平的变化而引起牙周组织炎症程度的变化情况，在该病例中，绝经史的询问对确定诊断意义不大，不需侧重询问。口腔卫生史（D错）主要是了解患者的日常口腔健康措施，主要针对菌斑性牙龈炎症增生的情况，病例中为药物性牙龈增生，故不需侧重询问口腔卫生史。口呼吸习惯（E错）患者常有牙龈表面因外露而干燥以及牙面缺乏自洁作用，而使菌斑堆积而产生龈炎，病例中为药物性牙龈增生，不需询问患者是否有口呼吸习惯。